儿童高热的首选的药物是
A. 美洛昔康
B. 尼美舒利
C. 对乙酰氨基酚
D. 塞来昔布
E. 依托考昔

正确答案：C。对乙酰氨基酚

解析：本题考查退烧药。对乙酰氨基酚（C对）是儿科临床最常用的退热剂，也是世界卫生组织（WHO）推荐2个月以上婴儿和儿童高热时首选退热药。美洛昔康（A错）不推荐15岁以下儿童使用。尼美舒利（B错）禁用于12岁以下儿童。